垂体后叶储存的激素是
A. 抗利尿激素
B. 生长激素
C. 促肾上腺皮质激素
D. 促甲状腺激素
E. 泌乳素

正确答案：A。抗利尿激素

解析：垂体后叶即神经垂体，不含腺细胞，自身不能分泌激素，但可储存来自下丘脑分泌的激素血管加压素（抗利尿激素）（A对）和缩宫素。